临床上常用的念珠菌实验室检测方法
A. 涂片法、培养法、基因诊断
B. 涂片法、培养法、组织病理学检查
C. 涂片法、培养法、免疫法
D. 培养法、活检法、基因诊断
E. 涂片法、免疫法、基因诊断

正确答案：B。涂片法、培养法、组织病理学检查

解析：念珠菌实验室检测方法包括涂片法、分离培养、组织病理学检查、免疫学和基因诊断等。一般来说，临床上常用的方法是前三种。掌握“口腔念珠菌病”知识点。